中药因药性及治疗疾病的不同，服药时间有别。关于服药时间的说法，正确的有
A. 六味地黄丸属补益药，宜饭前服用，有利于吸收
B. 桃核承气汤属活血化瘀药，宜饭后服用，避免胃肠道刺激
C. 病在胸膈以下，如肝、肾等脏器疾病，宜饭前服用，使药力直达病所
D. 病在胸膈以上，如头痛、眩晕，宜饭后服用，使药力停留于上焦
E. 峻下逐水药、攻积导滞药宜空腹服用，以发挥最佳药效

正确答案：A、C、D、E。六味地黄丸属补益药，宜饭前服用，有利于吸收；病在胸膈以下，如肝、肾等脏器疾病，宜饭前服用，使药力直达病所；病在胸膈以上，如头痛、眩晕，宜饭后服用，使药力停留于上焦；峻下逐水药、攻积导滞药宜空腹服用，以发挥最佳药效

解析：本题考查患者合理用药教育的服药时间。说法正确的是：六味地黄丸属补益药，宜饭前服用，有利于吸收（A对）；病在胸膈以下，如肝、肾疾病，宜饭前服用，使药力直达病所（C对）；病在胸膈以上，如头痛、眩晕，宜饭后服用，使药力留于上焦（D对）；峻下逐水药、攻积导滞药宜空腹服用，以发挥最佳药效（E对）。饭前服：补益药宜饭前服以利于吸收，如六味地黄丸、参苓白术散等；制酸药宜饭前服，以减少胃酸分泌，增强对胃黏膜的保护；病在胸膈以下，如肝、肾等脏器疾病宜饭前服，旨在使药力直达病所，发挥最佳效力。饭后服：对胃肠道有刺激的药物及苦寒伤胃之药宜饭后服；健胃消食药宜饭后服，如保和丸、大山楂丸等；病在胸膈以上，如头痛、眩晕、目疾、咽痛等宜饭后服，使药力停留于上焦，便于发挥药效。空腹服：峻下逐水药宜空腹服，可使药力直达病所，如《伤寒论》中的十枣汤方后注明要求清晨空腹服下。此外，一些活血化瘀药宜空腹服药，如仲景之桃核承气汤，其强调“先时”，后世医家在应用活血化瘀之剂时亦多注明“食前”或“空心服”（B错），体现了《神农本草经》之“病在四肢血脉者，宜空腹而在旦”的思想。